主要降低三酰甘油和VLDL-C的药物是
A. 洛伐他汀
B. 考来烯胺
C. 非诺贝特
D. 维生索 E
E. 藻酸双酯钠

正确答案：C。非诺贝特

解析：本题考查非诺贝特。非诺贝特（C对）为贝丁酸类调血脂药，在体内经酯酶的作用迅速代谢成非诺贝特酸而起降血脂作用，具有明显的降低血清胆固醇，甘油三酯和升高高密度脂蛋白的作用，降低TG的作用较强，适用于高TG血症或以TG升高为主的混合型高脂血症。洛伐他汀（A错）可抑制羟甲戊二酰辅酶A还原酶活性，临床用于预防动脉粥样硬化和冠心病，预防血栓形成。考来烯胺（B错）主要用于Ⅱ型高脂血症、动脉粥样硬化以及肝硬化、胆石病引起的瘙痒。维生素E（D错）用于进行性肌营养不良，以及心、脑血管疾病，习惯性流产及不孕症的辅助治疗。藻酸双酯钠（E错）用于缺血性心、脑血管病和高脂血症的防治。